医疗服务机构监督常用的方法主要包括
A. 审批支付监督
B. 抽查住院费用
C. 设置医疗费用预警监控系统
D. 定点医疗机构考核
E. 以上均包括

正确答案：E。以上均包括

解析：医疗服务机构监督常用的方法主要包括：①审批支付监督；②抽查住院费用；③设置医疗费用预警监控系统；④重点调查；⑤定点医疗机构考核。掌握“医疗保障”知识点。